某男，50岁。肝胆火旺，症见心烦不宁、头晕目眩、耳鸣耳聋、胁肋疼痛、脘腹胀痛、大便秘结，治当泻火通便，宜选用的成药是
A. 防风通圣丸
B. 当归龙荟丸
C. 通便灵胶囊
D. 双清口服液
E. 葛根芩连丸

正确答案：B。当归龙荟丸

解析：本题考查的是当归龙荟丸的功能。肝胆火旺，症见心烦不宁、头晕目眩、耳鸣耳聋、胁肋疼痛、脘腹胀痛、大便秘结，治当泻火通便，宜选用的成药是当归龙荟丸（B对）。当归龙荟丸：【功能】泻火通便。防风通圣丸（A错）：【功能】解表通里，清热解毒。通便灵胶囊（C错）：【功能】泻热导滞，润肠通便。双清口服液（D错）：【功能】疏透表邪，清热解毒。葛根芩连丸（E错）：【功能】解肌透表，清热解毒，利湿止泻。